三仁汤中具有“宣上、畅中、渗下”作用的药物是
A. 杏仁、草蔻仁、薏苡仁
B. 杏仁、白蔻仁、冬瓜仁
C. 杏仁、白蔻仁、薏苡仁
D. 杏仁、桃仁、薏苡仁
E. 桃仁、白蔻仁、薏苡仁

正确答案：C。杏仁、白蔻仁、薏苡仁

解析：该题考查三仁汤的方解。该题虽考查三仁汤的方解，但三仁汤的组成中“三仁”为杏仁、白蔻仁、生薏苡仁，题中选项仅有C选项为三仁汤的组成（C对）（ABDE错）。趣记：三人扑通滑竹下——三仁朴通滑竹夏。